构成小脑下脚的纤维束不出现
A. 脊髓小脑后束
B. 橄榄小脑纤维
C. 脑桥小脑束
D. 前庭小脑纤维
E. 前庭神经小脑纤维

正确答案：C。脑桥小脑束

解析：构成小脑下脚的纤维束不出现脑桥小脑束（C对），脑桥小脑束属于构成小脑中脚的纤维。脊髓小脑后束（A错）、橄榄小脑纤维（B错）、前庭小脑纤维（D错）、前庭神经小脑纤维（E错）均为构成小脑下角的纤维。